慢性肾脏病继发甲状旁腺功能亢进的始动因素是
A. 高磷血症
B. 低钙血症
C. 高钾血症
D. 高尿酸血症
E. 代谢性酸中毒

正确答案：A。高磷血症

解析：慢性肾脏病时，肾功能不全，尿磷排出减少，形成血磷升高。高血磷与血钙结合成磷酸钙沉积于软组织，导致软组织异位钙化，并使血钙降低，形成低钙血症（B错）。高磷血症、低钙血症刺激甲状旁腺分泌大量的甲状旁腺素（甲状旁腺素主要作用为升高血钙、降低血磷），引起继发性甲状旁腺功能亢进。因此，慢性肾脏病继发甲状旁腺功能亢进的始动因素是高磷血症（A对）。慢性肾脏病可出现高钾血症（C错）、高尿酸血症（D错）、代谢性酸中毒（E错），导致低钙血症的发生，引起继发性甲状旁腺功能亢进，都不是始动因素。